51岁女性，自述上腭无痛性肿块2年，长期咀嚼不适前来就诊。检查可见上腭处有一分叶状肿块，活动度差，质地较硬，无包膜。手术时快速病理切片报告为黏液细胞和表皮样细胞为主，中间细胞较少，则此病的恶性程度为
A. 高度恶性
B. 中度恶性
C. 低度恶性
D. 没有恶变
E. 以上均错

正确答案：C。低度恶性

解析：本题考查黏液表皮样癌。根据患者的临床表现和术中的病理表现可诊断为黏液表皮样癌的高分化型（低度恶性）（C对）。黏液表皮样癌分为3种类型：①高分化（低度恶性）型：黏液细胞和表皮样细胞为主，占肿瘤细胞的50%以上，中间细胞较少。②低分化（高度恶性）型：构成细胞主要是中间细胞和表皮样细胞，黏液细胞较少，低于10%，散在于表皮样细胞之间。肿瘤细胞异形性及核分裂象明显。③中分化（中度恶性）型：介于上述两型之间。